会导致凝血障碍的是
A. 先兆流产
B. 不全流产
C. 稽留流产
D. 难免流产
E. 复发流产

正确答案：C。稽留流产

解析：会导致凝血障碍的是稽留流产（C对），晚期流产稽留时间过长可能发生凝血功能障碍，导致弥散性血管内凝血。